高粘滞性多发性骨髓瘤最常见的类型
A. 轻链
B. IgA
C. IgE
D. IgM
E. IgG

正确答案：B。IgA

解析：IgG最常见 MM的高粘滞血症以IgA型最常见 淀粉样变中以IgD型最常见 答案应该为IgA。高黏滞综合征尤以IgM易聚合成多聚体，可使血液黏滞性过高（B对ACDE错）。